糖尿病人由于反复注射胰岛素，在注射局部出现红肿，出血，坏死等剧烈的炎症，应是
A. 类风湿性关节炎
B. 类Arthus反应
C. 血清病
D. 免疫复合物型肾小球性肾炎
E. SLE

正确答案：B。类Arthus反应

解析：类Arthus反应：局部反复注射胰岛素、抗毒素等可在注射局部出现以红肿、出血和坏死为特征的类Arthus反应。掌握“概述及Ⅰ型超敏反应”知识点。